某男，21岁，职业运动员。上周感冒后，出现鼻塞，流涕黄稠量多，嗅觉差，鼻黏膜红肿，伴头痛，发热。诊断为鼻渊。该患者应慎用的中成药是
A. 鼻渊通窍颗粒
B. 利鼻片
C. 胆香鼻炎片
D. 鼻渊片
E. 鼻渊舒胶囊

正确答案：A。鼻渊通窍颗粒

解析：本题考查鼻渊之风热蕴肺证的合理用药指导。结合患者症状诊断为鼻渊，应慎用的中成药是鼻渊通窍颗粒（A对）。鼻渊之风热蕴肺证【症状】鼻塞，涕黄稠而量多，嗅觉差，鼻黏膜红肿，可伴头痛，发热，汗出，胸闷，咳嗽，痰多。舌红，苔黄，脉浮数。【中成药应用】1.常用中成药：利鼻片（B错）、鼻渊通窍颗粒、鼻渊片、鼻舒适片。2.合理用药与用药指导：儿童、孕妇、哺乳期妇女及肝肾功能不全者禁用鼻渊片（D错）；孕妇慎用利鼻片。外感风寒或肺脾气虚者慎用利鼻片，且本品含有细辛、苍耳子，不宜过量、久用。脾虚腹胀者及运动员慎用鼻渊通窍颗粒。鼻渊之胆经郁热证【症状】脓涕量多，色黄或黄绿，或有臭味，鼻塞重，嗅觉差，鼻黏膜红赤。伴头痛较剧，口苦，咽干，目眩，耳鸣，耳聋，寐少梦多，烦躁易怒，小便黄赤。舌质红，舌苔黄或腻，脉弦数。【中成药应用】1.常用中成药：鼻渊舒胶囊、藿胆丸、胆香鼻炎片2.合理用药与用药指导：孕妇禁用胆香鼻炎片（C错）；慎用鼻渊舒胶囊（E错）、藿胆丸。肺脾气虚、气滞血瘀者慎用鼻渊舒胶囊，且本品含有细辛、苍耳子，不宜过量、久用。脾虚便溏者慎用藿胆丸。